为增加金合金瓷金结合力，除了
A. 去除金属表面污染物
B. 预氧化过程正确排气
C. 缩短冷却时间
D. 提高金属表面润湿性
E. 提高金和瓷热膨胀系数的匹配性

正确答案：C。缩短冷却时间

解析：适当增加其环境温度的冷却时间，可提高热膨胀系数的匹配性。掌握“修复材料、金瓷结合及树脂粘结机制”知识点。